《医疗机构制剂配制质量管理规范（试行）》属于
A. 法律
B. 行政法规
C. 地方性法规
D. 部门规章
E. 其他规范性文件

正确答案：D。部门规章

解析：本题考查部门规章。《医疗机构制剂配制质量管理规范（试行）》属于部门规章（D对）。药品管理现行有效的主要规章有20多部，包括《药品注册管理办法》《药物非临床研究质量管理规范》《药物临床试验质量管理规范》《药品生产监督管理办法》《药品生产质量管理规范》《医疗机构制剂配制质量管理规范（试行）》《医疗机构制剂配制监督管理办法（试行）》《医疗机构制剂注册管理办法（试行）》《药品经营监督管理办法》《药品经营质量管理规范》《中药材生产质量管理规范》《生物制品批签发管理办法》《处方药与非处方药分类管理办法》《药品进口管理办法》《直接接触药品的包装材料和容器管理办法》《药品说明书和标签管理规定》《药品不良反应报告和监测管理办法》《互联网药品信息服务管理办法》《药品召回管理办法》《食品药品行政处罚程序规定》《药品医疗器械飞行检查办法》等。与药品监督管理职责密切相关的法律（A错）主要有4部，包括《药品管理法》《中华人民共和国疫苗管理法》（以下简称《疫苗管理法》）《基本医疗卫生与健康促进法》《中华人民共和国禁毒法》；与药品管理有关的法律有《中华人民共和国刑法》《中华人民共和国广告法》《中华人民共和国价格法》《中华人民共和国消费者权益保护法》《中华人民共和国反不正当竞争法》《中华人民共和国专利法》等。行政法规（B错）是指作为国家最高行政机关的国务院根据宪法和法律所制定的规范性文件。地方性法规（C错）是根据本行政区域的实际需要，依法制定的在本行政区域内具有法律效力的规范性文件。规范性文件（E错）一般是指属于法律范畴的立法性文件和除此以外的由国家机关和其他团体、组织制定的具有约束力的非立法性文件的总和。